对多种氨基糖苷类钝化酶稳定，耳、肾毒性又低的药物是
A. 链霉素
B. 庆大霉素
C. 阿米卡星
D. 妥布霉素
E. 奈替米星

正确答案：E。奈替米星